肾病综合征的诊断标准不包括
A. 血清白蛋白<30g/L
B. 高血压
C. 水肿
D. 高脂血症
E. 尿蛋白>3.5g/24h

正确答案：B。高血压

解析：肾病综合征的诊断标准是：①大量蛋白尿（>3.5g/d）（E对）；②低白蛋白血症（血清白蛋白<30g/L）（A对）；③水肿（C对）；④高脂血症（D对）。高血压（B错。为本题正确答案）不是肾病综合征的诊断标准之一。